药品监督人员玩忽职守被降级，属于
A. 刑事责任
B. 行政责任
C. 民事责任
D. 违宪责任
E. 行政处分

正确答案：B。行政责任

解析：本题考查的是违规行为的性质、责任追究和划分。药品监督人员玩忽职守被降级，属于行政责任（B对）。个体诊所医生使用假药造成患者健康受损，处有期徒刑和罚款，属于刑事责任（A错）。药品批发企业在购销活动中违反合同约定，承担违约责任，属于民事责任（C错）。药品监督管理部门发现药品经营企业销售假药，吊销《药品经营许可证》，属于行政处分（E错）。